有关唇裂说法正确的是
A. 唇裂多见于下唇
B. 唇裂一般不伴有腭裂
C. 两侧的球状突与额鼻突未联合
D. 两侧球状突中央部分未联合
E. 较多见两侧下颌突未联合

正确答案：D。两侧球状突中央部分未联合

解析：唇裂：唇裂多见于上唇，由一侧或两侧的球状突与上颌突未联合或部分联合所致。唇裂还常伴有上颌侧切牙与尖牙之间的颌裂与腭裂。两侧球状突在中央部分未联合或部分联合，则形成上唇正中裂；两侧下颌突未联合则形成下唇唇裂，此两种唇裂罕见。掌握“面部的发育”知识点。